狂犬病的特征性病变
A. 干酪样坏死
B. 脂肪变
C. 内基小体
D. 伤寒结节
E. 网状软化灶

正确答案：C。内基小体

解析：狂犬病的特征性病变是在镜下发现神经细胞胞浆中具有诊断价值的嗜酸性包涵体，即内基小体（C对）。结核结节和干酪样坏死是结核病的特征性病变（A错）。伤寒结节是伤寒的特征性病变（D错）。